加速已吸收毒物的排泄应予
A. 针灸
B. 冲洗
C. 利尿
D. 洗胃
E. 吸氧

正确答案：C。利尿

解析：本题考查中毒解救。加速已吸收毒物的排泄应予利尿（C对）。大多数毒物进入机体后由肾脏排泄，因此强化利尿是加速毒物排泄的重要措施之一，通常采用的方法为静脉补液后，静注呋塞米20～40mg，也可选用其他利尿剂。注意事项：①由于利尿剂作用较强，对电解质平衡影响较大，所以必须在密切观察下使用，以免发生电解质紊乱；②肾衰竭者不宜采用强利尿剂；③考虑心脏负荷等情况。针灸（A错）用于眼科疾病主要可以治疗急性结膜炎、白内障，对眼内污染物无效。眼内污染毒物时，必须立即用清水冲洗（B错）至少5分钟，并滴入相应的中和剂；对固体的腐蚀性毒物颗粒，要用眼科器械取出异物。洗胃（D错）是指将一定成分的液体灌入胃腔内，混和胃内容物后再抽出，如此反复多次。其目的是为了清除胃内未被吸收的毒物或清洁胃腔，临床上用以胃部手术、检查前准备。吸氧（E错）用于纠正缺氧，提高动脉血氧分压和氧饱和度的水平，促进代谢，是辅助治疗多种疾病的重要方法之一，用于吸入性中毒。